鼻分为外鼻、鼻腔和鼻旁窦3部分，鼻腔借鼻中隔分为左、右两个腔。关于外鼻的组成，下列哪项是正确的
A. 鼻孔
B. 鼻后孔
C. 鼻前庭
D. 鼻旁窦
E. 由鼻骨和软骨作支架

正确答案：E。由鼻骨和软骨作支架

解析：外鼻以鼻骨和鼻软骨为支架（E对）。